肩胛骨
A. 属自由上肢骨
B. 属不规则骨
C. 下角平对第8肋
D. 喙突伸向前外侧上
E. 后面的横行骨嵴为肩胛冈

正确答案：E。后面的横行骨嵴为肩胛冈

解析：肩胛骨背侧面的横称嵴肩胛冈（E对）。肩胛骨为三角形扁骨”（B错）。肩胛冈属于上肢带骨（A错）。肩胛下角为脊柱缘与腋缘会合处，平对第 7 肋或第 7 肋间隙（C错）。肩胛骨上缘短而薄，外侧份有肩胛切迹，更外侧有向前的指状突起称喙突（D错）。